具有主动靶向作用的靶向制剂是
A. 常规脂质体
B. 微球
C. 纳米囊
D. pH敏感脂质体
E. 免疫脂质体

正确答案：E。免疫脂质体

解析：本题考查主动靶向制剂。主动靶向制剂是用修饰的药物载体作为“导弹”，将药物定向地运送到靶区浓集发挥药效。主动靶向制剂包括经过修饰的药物载体和前体药物与药物大分子复合物两大类制剂。修饰的药物载体有修饰脂质体、修饰微乳、修饰微球、修饰纳米球、免疫纳米球、免疫脂质体（E对）等；前体药物包括抗癌药及其他前体药物、脑部位和结肠部位的前体药物等。常规脂质体（A错）系一类由胆固醇和磷脂组成，含有脂质双层包围水相的内囊泡结构的脂质体，不具有主动靶向作用。微球（B错）和纳米囊（C错）为被动靶向制剂。pH敏感脂质体（D错）为物理化学靶向制剂。